听到脑子里有黄鼠狼在说话，但是听不清，诊断为什么
A. 反射性幻觉
B. 功能性幻觉
C. 假性幻觉
D. 心因性幻觉
E. 谵妄

正确答案：C。假性幻觉

解析：假性幻觉是存在于自己的主观空间内，不通过感觉器官而获得的幻觉。其特点为幻觉内容往往比较模糊、不清晰和不完整，故患者常常描述为没有通过耳朵或眼睛，大脑内就隐约出现了某种声音或影像。故听到脑子里有黄鼠狼在说话，但是听不清应为假性幻觉（C对）。反射性幻觉是一种伴随现实刺激而出现的幻觉，涉及两个不同的感觉器官，即当某一感官处于功能活动状态时，出现涉及另一感官的幻觉（A错）。功能性幻觉（B错）是一种伴随现实刺激而出现的幻觉，即当某种感觉器官处于功能活动状态同时出现涉及该器官的幻觉，正常知觉与幻觉并存，临床上常见功能性幻听。心因性幻觉（D错）是在强烈心理因素影响下出现的幻觉，幻觉内容与心理因素有密切联系，如看到亡故亲人的影子在房间里走动等。谵妄（E错）指患者在意识清晰度降低的同时出现大量的幻觉、错觉，这些幻觉和错觉以形象鲜明的恐怖性幻视和错视为主，如猛兽、毒蛇等，在恐怖性幻视及错视的影响下，患者往往产生紧张和恐惧的情绪反应。